白假丝酵母菌在玉米粉琼脂培养基上，可长出
A. 有性孢子
B. 厚膜孢子
C. 分生孢子
D. 子囊孢子
E. 关节孢子

正确答案：B。厚膜孢子

解析：白假丝酵母菌在普通的琼脂、血琼脂及沙氏葡萄糖（SDA）琼脂培养基上，均生长良好，菌落呈类酵母型；在玉米粉琼脂培养基上，可长出厚膜孢子。白假丝酵母菌的假菌丝和厚膜孢子有助于鉴定。掌握“真菌概述及主要病原性真菌”知识点。